某男，60岁，患类风湿性关节炎10年，症见肌肉、关节疼痛，僵硬畸形，屈伸不利，腰膝酸软，畏寒乏力。中医诊为尪痹，证属肝肾不足，风湿痹阻，处以尪痹颗粒，其药物组成为熟地黄、地黄、续断、淫羊藿、羊骨、附子（黑顺片）等。处方中，按照道地药材划分，地黄归属为
A. 广药
B. 怀药
C. 云药
D. 川药
E. 浙药

正确答案：B。怀药

解析：本题考查的是道地药材。按照道地药材划分，地黄归属为怀药（B对）。怀药：主产地河南。如著名的“四大怀药”——地黄、牛膝、山药、菊花；以及天花粉、瓜蒌、白芷、辛夷、红花、金银花、山茱萸等。广药（A错）：又称“南药”，主产地广东、广西、海南及台湾。如阳春砂、广藿香、广金钱草、益智仁、广陈皮、广豆根、蛤蚧、肉桂、桂莪术、苏木、巴戟天、高良姜、八角茴香、化橘红、樟脑、桂枝、槟榔等。云药（C错）：主产地云南。如三七、木香、重楼、茯苓、萝芙木、诃子、草果、马钱子、儿茶等。川药（D错）：主产地四川、西藏等。如川贝母、川芎、黄连、川乌、附子、麦冬、丹参、干姜、白芷、天麻、川牛膝、川楝子、川楝皮、川续断、花椒、黄柏、厚朴、金钱草、五倍子、冬虫夏草、麝香等。浙药（E错）：主产地浙江。如传统的“浙八味”——浙贝母、白术、延胡索、温郁金、玄参、杭白芍、杭菊花、杭麦冬；以及山茱萸、莪术、杭白芷、栀子、乌梅、乌梢蛇等。